开展一次以医院为基础的病例对照研究，最常见的偏倚是
A. 回忆偏倚
B. 失访偏倚
C. 入院率偏倚
D. 检出偏倚
E. 现患-新发病例偏倚

正确答案：C。入院率偏倚